女，43岁。右下腹持续性疼痛5天，伴恶心、呕吐，呕出物为胃内容物。体温38.5℃。体检发现右下腹5cm×5cm大小肿块，触痛明显。最可能的诊断是
A. 粪块所致肠梗阻
B. 盲肠肿瘤
C. 急性化脓性阑尾炎
D. 阑尾周围脓肿
E. 盲肠扭转

正确答案：D。阑尾周围脓肿

解析：女，43岁（患者为中年女性）。右下腹持续性疼痛5天（考虑阑尾、盲肠等器官疾病），伴恶心、呕吐，呕出物为胃内容物（肠道炎症状，无特异性）。体温38.5℃（考虑为炎症性疾病）。体检发现右下腹5cm×5cm大小肿块，触痛明显（考虑是否为脓肿）。综合患者的病史、症状、体征等，最可能的诊断是阑尾周围脓肿（D对）。当急性阑尾炎出现化脓或穿孔，如果此过程进展较慢，大网膜可移至右下腹部，将阑尾包裹并形成粘连，形成炎性肿块或阑尾周围脓肿（P371）。粪块所致肠梗阻（A错）好发于老年人，主要表现为机械性肠梗阻的痛、吐、胀、停止排气排便的症状；盲肠肿瘤（B错）好发于老年人，主要表现为全身症状、贫血、腹部肿块等症状；另外以上两种疾病不会出现全身性炎症以及肠道炎症状，右下腹亦可触及包块，但不会有触痛。急性化脓性阑尾炎（C错）表现为典型右下腹转移性疼痛，但除非进展为阑尾周围脓肿，否则右下腹不能触及炎症肿块。盲肠扭转（E错）极少发生，这是因为盲肠由后腹膜固定，活动度小。